5-羟色胺再摄取抑制剂若与单胺氧化酶抑制剂同时服用可能出现5-羟色胺综合征，严重者可致死，二者交替使用的时间间隔应不少于
A. 2日
B. 4日
C. 7日
D. 10日
E. 14日

正确答案：E。14日

解析：本题考查药物的联合应用。5-羟色胺再摄取抑制剂（SSRIs）与单胺氧化酶抑制剂（MAOIs）同时服用可能出现5-羟色胺综合征，因此当两者交替使用时，应使一种药物完全或几乎完全从体内排出。一般经过2周（14天）（E对），可认为已经完全从体内排出。